治疗失神发作的首选药是
A. 乙琥胺
B. 苯妥英钠
C. 硝西泮
D. 地西泮
E. 丙戊酸钠

正确答案：A。乙琥胺

解析：失神性发作（小发作）一般首选乙琥胺，因其不良反应少（A对）。